最易虫蛀的饮片是
A. 白芷
B. 麦冬
C. 白豆蔻
D. 香附
E. 山茱萸

正确答案：A。白芷

解析：本题考查的是虫蛀。最易虫蛀的饮片是白芷（A对）。虫蛀，是指饮片被虫蛀蚀，从而降低疗效或失去药用价值的现象。虫蛀对中药的危害较为严重，是一种常见的质量异常现象。淀粉、糖、脂肪、蛋白质等成分，是有利于蛀虫生长繁殖的营养物质，故含上述成分较多的饮片最易生虫，如白芷、北沙参、薏苡仁、柴胡、大黄、鸡内金等。麦冬（B错）易泛油。泛油：泛油习称“走油”，是指因饮片中所含挥发油、油脂、糖类等，在受热、受潮或贮藏保管不善时其表面返软、发黏、颜色变浑、呈现油状物质并发出油败气味的现象。泛油是一种酸败变质现象，影响疗效，甚至可产生不良反应。含油脂多的饮片，内部油脂易于溢出表面而造成走油现象。一般可分为两种，一种为含挥发油的饮片，其泛油是因挥发油在一定的外界条件下加速外移聚集，随后在外界作用下形成泛油变质，如当归、苍术等；另一种为含脂肪油的饮片，其泛油是因其中的脂肪酸变为游离脂肪酸后才会溢出表面，随后在外界作用下分解、腐败，发生变质，如柏子仁、桃仁、杏仁等。另外，含糖量多的饮片，常因受潮而造成返软而“走油”，如牛膝、麦冬、天冬、熟地、黄精等。白豆蔻（C错）易气味散失。气味散失：气味散失，是指饮片固有的气味在外界因素的影响下，或贮藏日久气味散失或变淡薄。药物固有的气味，是由其所含的各种成分决定的，主要是由挥发性物质组成，这些成分往往是治病的主要物质，如果气味散失或变淡薄，就会使药性受到影响，从而影响药效。饮片发霉、泛油、变色等，均能使其气味散失；环境温度过高，使含挥发油的药物如肉桂、沉香等，气味逐渐散失，失去油润而干枯，且温度越高挥发油挥发得越快；豆蔻、砂仁粉碎后气味会逐渐挥发散失。山萸肉（E错）易发霉。易发霉饮片有天冬、牛膝、独活、玉竹、黄精、白果、橘络、全瓜蒌、山茱萸、莲子心、枸杞子、大枣、马齿苋、大蓟、小蓟、大青叶、桑叶、哈蟆油、鹿筋、狗肾、水獭肝、蛤蚧、黄柏、白鲜皮、川槿皮、人参、党参、当归、知母、紫菀、菊花、红花、金银花、白及、木香、五味子、洋金花、蝼蛄、地龙、蕲蛇、蜈蚣、甘草、葛根、山柰、青皮、芡实、薏苡仁、栀子、羌活、黄芩、远志。香附（D错）储存中的质量变异现象，2022年考试指南未明确说明。